不属于骨折特有体征的是
A. 畸形
B. 骨擦音
C. 局部肿胀
D. 局部异常活动
E. 骨擦感

正确答案：C。局部肿胀

解析：骨折的三个特有体征为：畸形（A对）、异常活动（D对）、骨擦音（B对）或骨擦感（E对）。局部肿胀（C 错，为本题正确答案）是骨折的一般体征。